男性患儿，5岁，因与小朋友玩耍导致牙冠冠折，查牙龈轻微溢血，不松动，X光显示根尖牙周膜间隙轻微变窄，继承恒牙牙胚未受到任何影响，但是大面积牙本质外露，针对此患儿采取的处理方法不正确的是
A. 应该保留牙齿
B. 若有尖锐的组织边缘，应调磨圆钝
C. 光固化树脂修复
D. 若出现牙髓感染迹象，应该进行牙髓摘除术
E. 在治疗后一年再次复查

正确答案：E。在治疗后一年再次复查

解析：对于简单冠折的乳牙，如果存在划伤舌头等软组织的尖锐边缘，可采取调磨的方法。对患儿家长有美观要求，或大面积牙本质外露近髓的牙齿，可采取光固化复合树脂修复的方法。一般在术后3个月、6个月复查，如果发现牙髓感染的症状，应及时行牙髓摘除术。本题考查牙外伤概述及乳牙外伤。